能促进维生素B₁₂吸收的物质是
A. 胃蛋白酶
B. 盐酸
C. 碳酸氢盐
D. 内因子
E. 黏液

正确答案：D。内因子